板蓝根颗粒的功能是
A. 清热解毒，凉血利咽
B. 清热疏风，利咽解毒
C. 清热化湿，行气止痛
D. 清热泻火，散风止痛
E. 清热泻火，散结消肿

正确答案：A。清热解毒，凉血利咽

解析：本题考查的是板蓝根颗粒的功能。板蓝根颗粒的功能是清热解毒，凉血利咽（A对）。板蓝根颗粒：【功能】清热解毒，凉血利咽。香连丸：【功能】清热化湿，行气止痛（C错）。牛黄上清丸：【功能】清热泻火，散风止痛（D错）。功能为清热疏风，利咽解毒（B错）或清热泻火，散结消肿为（E错）的中成药，2022年考试指南未明确说明。